叶深绿色或黄绿色，细小鳞片状，交互对生，贴伏于枝上的药材是
A. 桑叶
B. 紫苏叶
C. 侧柏叶
D. 番泻叶
E. 大青叶

正确答案：C。侧柏叶

解析：本题考查的是侧柏叶的性状鉴别。叶深绿色或黄绿色，细小鳞片状，交互对生，贴伏于枝上的药材是侧柏叶（C对）。侧柏叶【性状鉴别】药材本品多分枝，小枝扁平。叶细小鳞片状，交互对生，贴伏于枝上，深绿色或黄绿色。质脆，易折断。气清香，味苦涩、微辛。禾本科植物叶的上表皮细胞有较大的运动细胞，如淡竹叶等；桑科植物如桑叶（A错）的表皮细胞较大，内含葡萄状钟乳体，而爵床科穿心莲叶的表皮细胞内含螺旋状的钟乳体；唇形科薄荷叶的表皮细胞内含簇状橙皮苷结晶体；豆科番泻叶表皮细胞内则含黏液质。紫苏叶（B错）【性状鉴别】药材叶片多皱缩卷曲、破碎，完整的叶展平后呈卵圆形，长4～11cm，宽2.5～9cm，先端长尖或急尖，基部圆形或宽楔形，边缘具圆锯齿。两面紫色或上表面绿色，下表面紫色，疏生灰白色毛，下表面有多数凹点状的腺鳞。番泻叶（D错）【性状鉴别】药材狭叶番泻：呈长卵形或卵状披针形，长1.5～5cm，宽0.4～2cm，叶端急尖，叶基稍不对称，全缘。上表面黄绿色，下表面浅黄绿色，无毛或近无毛，叶脉稍隆起。大青叶（E错）【性状鉴别】药材多皱缩卷曲，有的破碎。完整的叶片展平后呈长椭圆形至长圆状倒披针形，长5～20cm，宽2～6cm；上表面暗灰绿色，有的可见色较深稍突起的小点；先端钝，全缘或微波状，基部狭窄下延至叶柄呈翼状；叶柄长4～10cm，淡棕黄色。